男，35岁，田间耕作时被带锈铁钉刺伤右足，伤口约3cm，自行包扎未就医，6天后患者出现全身乏力，头晕，头痛，并觉张口困难，颈强直（+），头后仰，角弓反张。对造成该疾病的致病菌特点的描述，正确的是
A. 细菌形态为球菌
B. 致病菌素主要为内毒素
C. 感染必须具有缺氧环境
D. 革兰染色阴性
E. 芽孢对热、干燥不耐受

正确答案：C。感染必须具有缺氧环境

解析：青年男性患者，田间耕作时被带锈铁钉刺伤右足（破伤风的常见感染途径），伤口约3cm（伤口较深），自行包扎未就医（清创不彻底），6天后患者出现全身乏力，头晕，头痛，并觉张口困难，颈强直（+），头后仰，角弓反张（破伤风感染的典型体征），根据该患者的病史、临床表现及体征，应诊断为破伤风感染，病菌是破伤风梭菌（A错），为专性厌氧（C对），革兰染色阳性（D错），此菌对环境适应性很强，能耐煮沸（E错）。致病毒素主要是主要是痉挛毒素（B错）。